回忆偏倚是
A. 由于回忆不准确引起的偏倚
B. 由于对病例的诊断错误所引起的偏倚
C. 两者均是
D. 两者均否

正确答案：A。由于回忆不准确引起的偏倚

解析：本题考查回忆偏倚的概念。回忆偏倚是由于研究对象对暴露史或既往史回忆的准确性和完整性存在系统误差而引起的偏倚（A对BCD错）。